“坚硬色紫，垒垒青筋，盘区若蚯蚓状”者，指的是
A. 肉瘤
B. 瘿瘤
C. 筋瘤
D. 粉瘤
E. 脂瘤

正确答案：C。筋瘤

解析：《外科正宗·瘿瘤论》云：“筋瘤者，坚硬色紫，垒垒青筋，盘区甚者，结若蚯蚓”。筋瘤是以筋脉色紫，盘曲突起，状如蚯蚓，形成团块为主要表现的浅表静脉病变（C对）。《外科正宗·瘿瘤论》云：“肉瘤者，软若棉，肿似馒，皮色不变，不紧不宽”（A错）。瘿瘤，病名，即瘿与瘤的合称，或单指瘿（B错）。脂瘤是以皮肤间出现圆形质软的肿块，溃破后可见粉渣样物溢出为主要表现的肿瘤性疾病，又称粉瘤。《外科真诠·瘿瘤》云：“先用线针于瘤头上针一分深。用手捻之，若是白浆便是粉瘤。”相当于西医的皮脂腺囊肿（DE错）。